错误的是
A. 应定期监测地高辛血药浓度
B. 在患者症状好转后应立即停用比索洛尔
C. 应注意观察是否有黑便
D. 应定期监测血压、心率
E. 应依情况调整地高辛剂量

正确答案：B。在患者症状好转后应立即停用比索洛尔

解析：本题考查比索洛尔。比索洛尔属于β受体阻断剂，长期应用者突然停药可发生反跳现象（B错，为本题正确答案），即原有的症状加重或出现新的表现，较常见有血压反跳性升高，伴头痛、焦虑等，称之为撤药综合征。地高辛用于高血压、瓣膜性心脏病、先天性心脏病等急性和慢性心功能不全，尤其适用于伴有快速心室率的心房颤动的心功能不全等，用药期间应注意监测地高辛血药浓度（A对）、血压、心律（D对）、心率、心电图等，依情况调整地高辛剂量（E对），且该患者需要注意观察是否有黑便（C对），大便出现黑色，一般是上消化道出血，胃和十二指肠出血，血通过几米长的肠道，发生各种化学变化，才会逐渐变黑。